链的主要功能是
A. 促进MHCⅡ类分子α链与β链组装和折叠
B. 促进MHCⅡ类分子二聚体形成
C. 位于粗面内质网膜上
D. 促进MHCⅡ类分子在粗面内质网内与其他内源性多肽结合
E. 促进MHCⅡ类分子二聚体在细胞内的转运

正确答案：D。促进MHCⅡ类分子在粗面内质网内与其他内源性多肽结合